预防艾滋病母婴传播的先决条件是
A. 广泛开展预防艾滋病母婴传播的健康教育
B. 艾滋病检测与咨询
C. 建立预防艾滋病母婴传播的健康教育网络
D. 设立婚前保健门诊
E. 社会经济因素支持

正确答案：B。艾滋病检测与咨询

解析：本题考查预防艾滋病母婴传播的先决条件。艾滋病检测与咨询（B对）是预防艾滋病母婴传播的先决条件，也是最重要的内容之一。母婴传播是艾滋病传播感染主要途径，应广泛开展预防艾滋病母婴传播的健康教育（A错），建立预防艾滋病母婴传播的健康教育网络（C错），确保社会经济因素的支持（E错），设立婚前保健门诊等（D错）。